氨基糖苷类作用机制是
A. 抑制细菌蛋白质合成
B. 抑制细菌代谢
C. 干扰细菌核酸代谢
D. 抑制细菌细胞壁合成
E. 干扰真菌细胞膜功能

正确答案：A。抑制细菌蛋白质合成

解析：本题考查氨基糖苷类的作用机制。氨基糖苷类药的抗菌作用机制是抑制细菌蛋白质的合成（A对）。抑制细菌代谢（B错）的是磺胺类药物。干扰细菌核酸代谢（C错）的是喹诺酮类。抑制细菌细胞壁合成（D错）的有头孢菌素类和青霉素类等。干扰真菌细胞膜功能（E错）的有两性霉素B。